下列哪种疾病与结肠癌关系最密切
A. 回盲部结核
B. 家族性结肠息肉病
C. 溃疡性结肠炎
D. 血吸虫性肉芽肿
E. 克罗恩病

正确答案：B。家族性结肠息肉病

解析：家族性肠息肉病（B对）是结肠癌前期病变，与结肠癌关系最为密切。溃疡性结肠炎（C错）、血吸虫性肉芽肿（D错），与结肠癌的发生有一定关系，但并不是癌前病变。回盲部结核（A错）与克隆病（E错）均多发于回肠末端，且二者属于炎性病变，无癌变可能。